关于含麻黄碱复方制剂管理的说法，正确的有
A. 从事含麻黄碱复方制剂批发业务的药品经营企业，应具有蛋白同化制剂、肽类激素的经营出资质
B. 药品零售企业销售含麻黄碱复方制剂，应直验购买者的身份证并进行登记
C. 药品零售企业销售含麻黄碱复方制剂，除处方药处方剂量销售外，一次销售不得超过5个最小包装
D. 药品零售企业不得开架含麻黄碱复方制剂，应设专柜由专人管理

正确答案：A、B、D。从事含麻黄碱复方制剂批发业务的药品经营企业，应具有蛋白同化制剂、肽类激素的经营出资质；药品零售企业销售含麻黄碱复方制剂，应直验购买者的身份证并进行登记；药品零售企业不得开架含麻黄碱复方制剂，应设专柜由专人管理

解析：本题考查含麻黄碱类复方制剂的管理。关于含麻黄碱复方制剂管理的说法，正确的有从事含麻黄碱复方制剂批发业务的药品经营企业，应具有蛋白同化制剂、肽类激素的经营出资质（A对）；药品零售企业销售含麻黄碱复方制剂，应直验购买者的身份证并进行登记（B对）；药品零售企业不得开架含麻黄碱复方制剂，应设专柜由专人管理（D对）。含麻黄碱类复方制剂的管理：（一）经营行为管理：1.具有蛋白同化制剂、肽类激素定点批发资质的药品经营企业，方可从事含麻黄碱类复方制剂的批发业务。2.严格审核含麻黄碱类复方制剂购买方资质，购买方是药品批发企业的必须具有蛋白同化制剂、肽类激素定点批发资质。药品零售企业应从具有经营资质的药品批发企业购进含麻黄碱类复方制剂。药品批发企业销售含麻黄碱类复方制剂时，应当核实购买方资质证明材料、采购人员身份证明等情况，核实无误后方可销售，并跟踪核实药品到货情况，核实记录保存至药品有效期后一年备查。3.除个人合法购买外，禁止使用现金进行含麻黄碱类复方制剂交易。4.发现含麻黄碱类复方制剂购买方存在异常情况时，应当立即停止销售，并向有关部门报告。（二）销售管理：2012年9月4日，原国家食品药品监督管理局、公安部、卫生部联合发布《关于加强含麻黄碱类复方制剂管理有关事宜的通知》（国食药监办〔2012〕260号），该通知对含麻黄碱类复方制剂的销售管理作出了新的规定。主要包括以下几个方面。1.将单位剂量麻黄碱类药物含量大于30mg（不含30mg）的含麻黄碱类复方制剂，列入必须凭处方销售的处方药管理。医疗机构应当严格按照《处方管理办法》开具处方。药品零售企业必须凭执业医师开具的处方销售上述药品。2.含麻黄碱类复方制剂每个最小包装规格麻黄碱类药物含量口服固体制剂不得超过720mg，口服液体制剂不得超过800mg。3.药品零售企业销售含麻黄碱类复方制剂，应当查验购买者的身份证，并对其姓名和身份证号码予以登记。除处方药按处方剂量销售外，一次销售不得超过2个最小包装（C错）。查验购买者的身份证，系指购买者合法有效的身份证件，包括居民身份证、军人证件、护照等。4.药品零售企业不得开架销售含麻黄碱类复方制剂，应当设置专柜由专人管理、专册登记，登记内容包括药品名称、规格、销售数量、生产企业、生产批号、购买人姓名、身份证号码。5.药品零售企业发现超过正常医疗需求，大量、多次购买含麻黄碱类复方制剂的，应当立即向当地药品监管部门和公安机关报告。6.含麻黄碱类复方制剂的生产企业应当切实加强销售管理，严格管控产品销售渠道，确保所生产的药品在药用渠道流通。7.国家药品监督管理部门于2013年10月29日印发《关于加强互联网药品销售管理的通知》（食药监药化监〔2013〕223号），明确规定含麻黄碱类复方制剂（含非处方药品种）一律不得通过互联网向个人消费者销售。（三）广告管理：对按处方药管理的含麻黄碱类复方制剂，其广告只能在医学、药学专业刊物上发布；不得在大众传播媒介发布广告或者以其他方式进行以公众为对象的广告宣传。